用于抗结核杆菌的药物是
A. 妥布霉素
B. 链霉素
C. 庆大霉素
D. 阿米卡星
E. 大观霉素

正确答案：B。链霉素

解析：本题考查链霉素的作用。链霉素（B对）为氨基糖苷类抗菌药物，与其它抗结核药联合用于结核分枝杆菌所致各种结核病的初治病例。庆大霉素（C错）用于敏感革兰阴性杆菌所致的严重感染。妥布霉素（A错）与一种抗绿脓杆菌青霉素、氨曲南或头孢他啶合用，治疗绿脓杆菌引起的各种感染。阿米卡星（D错）广泛用于对庆大霉素及妥布霉素耐药的革兰阴性杆菌感染和大多数需氧革兰阴性杆菌感染，并对结核分枝杆菌有效。大观霉素（E错）用于淋病奈瑟菌所致的尿道炎、前列腺炎、宫颈阴道炎和直肠感染，以及对青霉素、四环素等耐药菌株引起的感染。